构成移植物排斥反应的损伤机制中主要的作用是
A. NK活化后杀伤的植物
B. Th产生TNF-α的作用
C. Tc的细胞毒作用
D. ADCC
E. 活化的Mφ发挥的效应

正确答案：C。Tc的细胞毒作用